治疗应首选
A. 凉膈散
B. 泻心导赤汤
C. 清胃散
D. 泻心汤
E. 六味地黄丸

正确答案：B。泻心导赤汤

解析：由“舌上溃破，色红疼痛，又有进食哭闹，心烦不安，口干欲饮”可诊断为口疮心火上炎证，治以清心凉血，泻火解毒，方选泻心导赤汤（B对）。凉膈散清热解毒，泻火解毒，清上泄下，用于上中焦邪郁生热证（A错）。清胃散清脏腑热，清胃凉血（C错）。邪火内炽，迫血妄行，吐血，衄血，便秘溲赤；或湿热内蕴而成黄疸，胸痞烦热；三焦积热，眼目赤肿，口舌生疮，外证疮疡，心胸烦闷，大便秘结；湿热黄疸，胸中烦热痞满，舌苔黄腻，脉数实者用泻心汤（D错）。六味地黄丸滋阴降火，引火归原，可用于虚火上浮之口疮（E错）。